某男，18岁，夏季贪凉饮冷，遂致外感于寒，内伤于湿，症见恶寒发热，无汗头痛，头重身倦，胸闷泛恶，舌苔薄白而腻。医师诊为阴暑，处方为香薷、厚朴、白扁豆，水煎服。香薷治阴暑的最佳服用方法是
A. 水煎凉服
B. 水煎温服
C. 浓煎温服
D. 研末冲服
E. 为丸吞服

正确答案：A。水煎凉服

解析：本题考查的是香薷的用法用量。香薷治阴暑的最佳服用方法是水煎凉服（A对）。香薷：【用法用量】内服：煎汤，3～10g；或入丸散。外用：适量，捣敷。或煎汤含漱。发汗解暑宜水煎凉服（B错），利水退肿须浓煎服（C错）或为丸服（E错）。